白血病的首发表现常为
A. 贫血
B. 高热
C. 感染
D. 出血
E. 紫癜

正确答案：A。贫血

解析：白血病常以贫血为首发表现，且进行性加重。掌握“急性白血病”知识点。